诸风掉眩，皆属于
A. 肺
B. 肾
C. 心
D. 肝
E. 脾

正确答案：D。肝

解析：诸风掉眩，皆属于肝的意思为种肢体搐动震摇、头晕目眩之风类病证，其病机多属于肝。这是由于肝为风木之脏，其病变多化风。肝藏血，主身之筋膜，开窍于目，其有病变则木失滋荣，伤及所合之筋、所主之目窍，则见肢体摇摆震颤、目眩头晕（D对）。诸气膹郁，皆属于肺（A错）。诸寒收引，皆属于肾（B错）。诸痛痒疮，皆属于心（C错）。诸湿肿满，皆属于脾（E错）。